既能凉血消斑，又定惊的药是
A. 青黛
B. 白薇
C. 连翘
D. 玄参
E. 紫草

正确答案：A。青黛

解析：本题考查的是青黛的功效。既能凉血消斑，又定惊的药是青黛（A对）。青黛：【功效】清热解毒，凉血消斑，定惊。白薇（B错）：【功效】退虚热，凉血清热，利尿通淋，解毒疗疮。连翘（C错）：【功效】清热解毒，疏散风热，消肿散结，利尿。玄参（D错）：【功效】清热凉血，滋阴降火，解毒散结，润肠。紫草（E错）：【功效】凉血活血，解毒透疹。